赵某，男，27岁。发热咳嗽月余，伴身体乏力消瘦，近l周来咯血，体温波动在37.5℃～38℃之间，X线胸片示右肺上叶后段炎性阴影，其中可见透亮区，血沉增快，结核菌素试验阳性。最可能的诊断是
A. 支气管扩张伴感染
B. 癌性空洞
C. 肺脓肿
D. 空洞型肺结核
E. 血行播散型肺结核

正确答案：D。空洞型肺结核

解析：该成年患者发热咳嗽月余，伴身体乏力消瘦，近l周来咯血，体温波动在37.5℃～38℃之间。影像学检查：X线胸片示右肺上叶后段炎性阴影，其中可见透亮区。实验室检查：血沉增快，结核菌素试验阳性（表示有结核杆菌感染）。综合该患者的病史、影像学检查、痰菌检查，该患者诊断考虑为空洞型肺结核（D对）；支气管扩张有慢性咳嗽、咳痰及反复咯血史，但痰结核杆菌阴性（A错）；癌性空洞肺癌常有刺激性咳嗽、痰中带血或咯血、胸痛及进行性消瘦等症状，常无明显全身中毒症状。X线胸片示癌肿呈分叶状，病灶边缘常有切迹、毛刺（B错）；肺脓肿起病较急，高热，大量脓痰，痰菌培养无结核菌。肺脓肿空洞多见于肺下叶，洞内常有液平面，周围有炎性浸润（C错）；血行播散型肺结核多见于婴幼儿和青少年，特别是抵抗力低下小儿，起病急，有高热等中毒症状，全身浅表淋巴结肿大，肝脾肿大，常伴发结核性脑膜炎。X线胸片显示肺内大小、密度、分布均匀的粟粒状结节阴影。亚急性及慢性血行播散型肺结核起病缓慢，症状较轻，常为间歇性低热、盗汗、乏力、轻度咳嗽等，部分患者无或仅有轻度全身中毒症状。X线胸片呈现大小不一、病灶新鲜、陈旧不等、分布不均匀的粟粒状结节阴影（E错）。